鼓膜是一半透明薄膜，分隔外耳与中耳，能感应很宽频谱内的微小声压变化，并将声音空气传递转变为机械振动。鼓膜
A. 呈漏斗状，其内面凹陷
B. 鼓膜脐内侧面有锤骨头附着
C. 紧张部在上方
D. 在鼓膜脐的前下方可见光锥
E. 以上均不正确

正确答案：D。在鼓膜脐的前下方可见光锥

解析：鼓膜边缘的大部分附着于颞骨上，中心向内凹陷（A错），称鼓膜脐，为锤骨柄末端（B错）附着处。鼓膜下3/4 区（C错），坚实紧张，为紧张部。鼓膜脐的前下方，有一三角形的反光区，称光锥（D对）。